男性，20岁，1小时前被刀刺伤来诊，血压60/50mmHg，面色苍白，呼吸困难，颈静脉怒张，呼吸音尚好，心音遥远，伤口在左锁骨中线第4肋间，最可能的诊断是
A. 肺损伤
B. 开放气胸
C. 心包积血
D. 血胸
E. 张力气胸

正确答案：C。心包积血

解析：青年男性，被刀刺伤，伤口在左锁骨中线第4肋间（提示可能有心包损伤），血压60/50mmHg（低于正常值90～140/60～90mmHg），面色苍白，提示有大量失血，呼吸困难，颈静脉怒张，心音遥远（提示心脏压塞），结合患者病史和临床表现，最可能的诊断为心包积血（C对）。肺损伤（A错）多表现为呼吸困难、咯血，无颈静脉怒张、心音遥远。开放性气胸（B错）主要表现为呼吸困难、口唇发绀、颈静脉怒张，气管向健侧移位，伤侧叩诊呈鼓音，呼吸音消失。血胸（D错）可有呼吸急促和血压下降、面色苍白等失血性休克表现，患侧肋间隙饱满、呼吸音消失，叩诊呈浊音，气管向健侧移位。张力性气胸（E错）表现为严重或极度呼吸困难、烦躁、意识障碍等，气管明显移向健侧，颈静脉怒张，伤侧胸部饱满，叩诊呈鼓音，呼吸音消失。